下列是典型心绞痛的心电图改变的是
A. 面对缺血区导联ST段水平压低≥0.lmV，T波倒置
B. 面对缺血区导联ST段抬高，T波高尖
C. 面对缺血区导联Q波加深，深度≥R波的1/4
D. 面对缺血区导联Q波加宽，宽度≥0.04秒
E. QRS波群宽大畸形

正确答案：A。面对缺血区导联ST段水平压低≥0.lmV，T波倒置

解析：典型心绞痛心电图表现为面对缺血区导联ST段水平压低≥0.lmV，T波倒置（A对），心绞痛主要由心肌缺血引起，典型心绞痛的心电图表现即为心肌缺血的心电图表现。面对缺血区导联ST段抬高，T波高尖（B错）为变异型心绞痛的临床心电图改变。面对缺血区导联Q波加深，深度≥R波的1/4（C错）为“坏死型”心肌梗死的改变。面对缺血区导联Q波加宽，宽度≥0.04秒（D错）提示心肌梗死。QRS波群宽大畸形（E错）见于室性期前收缩、室性心动过速、不完全性室内传导阻滞等心律失常。